男性，25岁，口腔内上下前牙龈乳头消失并凹陷，呈反波浪形，牙龈间乳头颊舌侧分离，可从牙面翻开，下方有牙石、牙垢，无龈坏死物。可能的原因是
A. 疱疹性龈口炎
B. 中性粒细胞缺乏引起龈坏死
C. 慢性龈缘炎
D. 慢性坏死性龈炎
E. 龈乳头炎

正确答案：D。慢性坏死性龈炎

解析：本题考查坏死性溃疡性龈炎。若在急性期治疗不彻底或反复发作可转为慢性坏死性龈炎（D对）。其主要临床表现为牙龈乳头严重破坏，甚至消失，乳头处的龈高度低于龈缘高度，呈反波浪状，牙龈乳头处颊舌侧牙龈分离，甚至可从牙面翻开，其下的牙面上有牙石和软垢，牙龈一般无坏死物。